清热固经汤适合于下列哪型崩漏
A. 虚热
B. 实热
C. 肾阴虚
D. 血瘀
E. 脾虚

正确答案：B。实热

解析：崩漏虚热证治宜养阴清热，固冲止血，方选上下相资汤（A错）。崩漏实热证治宜清热凉血，固冲止血，方选清热固经汤（B对）。崩漏肾阴虚证治宜滋肾益阴，固冲止血，方选左归丸合二至丸或滋阴固气丸（C错）。崩漏血瘀证治宜活血化瘀，固冲止血，方选逐瘀止血汤或将军斩关汤（D错）。崩漏脾虚证治宜补气摄血，固冲止崩，方选固本止崩汤（E错）。